一孕妇，妊娠35周，到医院检查，这个阶段保健主要目的是
A. 及早发现妊娠合并症及并发症，判断孕妇能否继续妊娠
B. 监测胎儿宫内生长发育、筛查胎儿畸形
C. 筛查与治疗妊娠合并症及并发症
D. 入院待产
E. 接受超声检查

正确答案：C。筛查与治疗妊娠合并症及并发症

解析：本题考查孕晚期保健。妊娠35周，为孕晚期，保健主要的目的是为监测胎儿宫内生长发育及安危状况、筛查及治疗妊娠合并症及并发症（C对ABDE错）。孕早期保健主要目的是对孕妇健康作全面评估，及早发现合并症及并发症，衡量合并症与妊娠的相互关系，判断孕妇能否继续妊娠。孕中期保健主要目的是动态监测已存在高危因素。监测胎儿宫内生长发育、筛查胎儿畸形、预防妊娠合并症及并发症。